普萘洛尔可引起
A. 血压升高
B. 瞳孔扩大
C. 骨骼肌松弛
D. 腺体分泌增加
E. 心脏兴奋性下降

正确答案：E。心脏兴奋性下降

解析：本题考查普萘洛尔。普萘洛尔为β受体阻断剂，可阻断心脏β₁受体，使心脏兴奋性下降（E对），降低血压（A错）。普萘洛尔无扩瞳、肌松、促进腺体分泌作用。